属于多巴胺D₂受体拮抗剂的是
A. 米索前列醇
B. 哌仑西平
C. 法莫替丁
D. 兰索拉唑
E. 多潘立酮

正确答案：E。多潘立酮

解析：本题考查多巴胺D₂受体拮抗剂。多潘立酮（E对）又名吗丁啉，为外周多巴胺D₂受体阻断剂，可直接阻断胃肠道多巴胺D₂受体，具有较强的促胃运动和止吐作用。前列腺素类似物米索前列醇（A错）具有增强黏膜抗损伤能力和加速溃疡愈合的作用；选择性抗胆碱能药物哌仑西平（B错）对胃壁细胞的毒蕈碱受体有高度亲和力，而对平滑肌，心肌和唾液腺等的毒蕈碱受体的亲和力低；组胺H₂受体阻断剂法莫替丁（C错），可显著抑制胃酸分泌；质子泵抑制剂兰索拉唑（D错）是抑制胃酸分泌和防治消化性溃疡的最有效药物。